前牙因美观需要考虑将冠缘放到龈下，应遵循的原则是
A. 前牙美观原则
B. 利于清洁
C. 修复体密合
D. 少量磨除牙体组织
E. 不侵犯生物学宽度

正确答案：E。不侵犯生物学宽度

解析：只有在前牙因美观需要或龋坏已达龈下，或牙冠较短需增加固位等情况下，才考虑将冠缘放到龈下，但应遵循“不侵犯生物学宽度”的原则。如果将修复体放到龈缘以下过多，可能出现两种不良反应：①组织为避让冠缘的激惹而发生牙槽嵴顶吸收和牙龈退缩；②牙龈发生炎症和肿胀。掌握“牙周健康与修复”知识点。